男，40岁，因呼吸困难和水肿入院。查体发现颈静脉怒张，肝在右肋缘下4cm，表面光滑，轻度压痛，双下肢压陷性水肿。检查心脏时可能发现
A. 心尖搏动向左下移位
B. 心脏形态呈靴形
C. 心尖部可听到舒张期杂音
D. 主动脉瓣区可听到粗糙的收缩期杂音
E. 主动脉瓣第二听诊区可听到叹气样舒张期杂音

正确答案：C。心尖部可听到舒张期杂音

解析：患者中年男性，有呼吸困难和水肿症状，查体：颈静脉怒张，肝大伴压痛，双下肢压陷性水肿，考虑诊断为右心衰竭。主动脉瓣第二听诊区可听到叹气样舒张期杂音（E错）提示主动脉瓣关闭不全，此时左心室血液摄入主动脉可反流至左心室，导致左心室容量负荷增加，随着病情发展，心室代偿性肥厚，心尖搏动向左下移位（九版诊断学P143）（A错），心脏可呈靴型（九版诊断学P147）（B错）。主动脉瓣区可听到粗糙的收缩期杂音（D错），提示主动脉瓣狭窄。ABDE四个选项的内容均提示主动脉瓣病变，但主动脉瓣病变多引起左心衰竭。心尖部可听到舒张期杂音（C对）提示二尖瓣狭窄（P287），二尖瓣狭窄晚期可引起右心衰竭，因此患者可能为二尖瓣狭窄引起的右心衰竭，检查心脏时可能发现心尖部可听到舒张期杂音。